初产妇，30岁，妊娠30周，视物模糊1天，孕前体健，查体：BP160/105mmHg，P150次/分，双下肢明显水肿，蛋白尿定量2g/24h，最可能的诊断是
A. 妊娠合并慢性肾炎
B. 妊娠期高血压
C. 子痫前期
D. 慢性肾炎
E. 子痫

正确答案：C。子痫前期

解析：妊娠30周，孕前体健，查体：BP160/105mmHg（收缩压≥140mmHg和或舒张压≥90mmHg），双下肢明显水肿。实验室检查：蛋白尿定量2g/24h（＞0.3g/24h） ，易诊断为子痫前期。又因患者收缩压≥160mmHg，故为子痫前期（C对）。妊娠期高血压（B错）患者尿蛋白（-）。子痫（E错）主要临床表现为子痫前期基础上发生不能用其他原因解释的抽搐。